以下哪种细胞不是牙周膜中的细胞成分
A. 成纤维细胞
B. 成骨细胞
C. 成牙骨质细胞
D. 破骨细胞
E. 成牙本质细胞

正确答案：E。成牙本质细胞

解析：成牙本质细胞位于牙本质近牙髓侧，而牙周膜位于牙槽骨侧，成牙本质细胞不是牙周膜中的细胞成分。掌握“牙周膜”知识点。